具有肃杀、收敛、沉降等作用或特性的事物，其属性是
A. 火
B. 土
C. 水
D. 木
E. 金

正确答案：E。金

解析：该题考查五行特性。金曰从革为凡具有沉降、肃杀、收敛等性质或作用的事物和现象，归属于金（E对）。火曰炎上为凡具有温热、上升、光明等性质或作用的事物和现象，归属于火（A错）。土曰稼穑为凡具有生化、承载、受纳等性质或作用的事物和现象，归属于土（B错）。水曰润下为凡具有滋润、下行、寒凉、闭藏等性质或作用的事物和现象，归属于水（C错）。木曰曲直为凡具有生长、升发、条达、舒畅等性质或作用的事物和现象，归属于木（D错）。